耳内不附有黏膜的结构是
A. 乳突窦
B. 乳突小房
C. 鼓室
D. 咽鼓管
E. 弹性软骨

正确答案：E。弹性软骨

解析：鼓室内面及上述结构均被覆有黏膜（C对），此黏膜与咽鼓管（D对）和乳突窦（A对）、乳突小房（B对）的黏膜相延续。耳郭的上方大部以弹性软骨为支架，外覆皮肤，皮下组织少（E错,为本题正确答案）。